化妆品的二级污染是指
A. 化妆品较轻的污染
B. 化妆品较重的污染
C. 生产过程的污染
D. 使用过程的污染
E. 储藏运输过程的污染

正确答案：D。使用过程的污染

解析：本题考查化妆品的二级污染。化妆品的二级污染是指在使用过程中受到的污染（D对ABCE错）。化妆品启封后，使用或存放过程中发生的污染，包括手部接触化妆品后将微生物带入，空气中的微生物落入而被污染。